对抗肿瘤药物环磷酰胺描述错误的是
A. 含有一个结晶水时为固体
B. 水溶液不稳定，溶解后应在短期内使用
C. 代谢后生成去甲氮芥，直接产生烷基化作用
D. 代谢后产生4-羟基磷酰胺，直接产生烷基化作用
E. 代谢后生成丙烯醛，可引起膀胱毒性

正确答案：D。代谢后产生4-羟基磷酰胺，直接产生烷基化作用

解析：本题考查环磷酰胺。环磷酰胺代谢后首先生成4-羟基环磷酰胺，进一步代谢为4-酮基环磷酰胺（D错，为本题正确答案）。环磷酰胺含有一个结晶水时为固体（A对）。水溶液不稳定，溶解后应在短期内使用（B对）。磷酰氮芥可经非酶水解生成去甲氮芥，直接产生烷基化作用（C对）。代谢生成的丙烯醛可引起膀胱毒性（E对）。